县以上卫生行政部门对学校卫生工作行使监督职权，其职责不包括
A. 对新建、改建、扩建校舍的选址、设计实行卫生监督
B. 对学校内影响学生健康的学习、生活、劳动、环境、食品等方面的卫生和传染病防治工作实行卫生监督
C. 对学校内的生活饮用水的卫生实行卫生监督
D. 对学生使用的文具实行卫生监督
E. 对学生使用的娱乐器具，保健用品实行卫生监督

正确答案：C。对学校内的生活饮用水的卫生实行卫生监督